易经乳汁分泌的药物的特征是
A. 蛋白结合率高
B. 弱酸性
C. 脂溶性大
D. 分子量大
E. 极性强

正确答案：C。脂溶性大

解析：本题考查哺乳期用药。乳汁比母体血液pH值低，碱性药物、脂溶性药物（B对）、分子量小的药物容易分泌到乳汁中。蛋白结合率高（A错）的药物不易分布到乳汁中，弱酸性（B错）药物主要分布在pH值更高的血液中，分子量大（D错）的药物不容易穿透细胞膜，而极性强（E错）的药物脂溶性小。